肾性与中枢性尿崩症的鉴别方法是
A. 禁水（禁饮）试验
B. 测定尿渗透压和血钠
C. 测定尿渗透压和比重
D. 测定血浆和尿渗透压
E. 加压素试验

正确答案：E。加压素试验

解析：肾性尿崩症是一种家族性X连锁遗传性疾病，90％的患者肾小管对AVP不敏感，注射加压素后尿量不减少，尿比重不增加，尿渗透压亦不升高，血浆AVP浓度正常或升高，而中枢性尿崩症患者体内AVP缺乏，肾小管对AVP敏感，注射外源性AVP后，尿渗透压升高，因此加压素试验（E对）为鉴别肾性尿崩症与中枢性尿崩症的有效方法。禁水试验（A错）常用于鉴别正常人与尿崩症。肾性尿崩症与中枢性尿崩症均表现为肾小管重吸收水的功能障碍，导致多尿、烦渴、多饮与低比重尿和低渗尿。因此测定血浆渗透压、血钠、尿渗透压、尿比重（BCD错）不是二者的鉴别方法。